关于氯丙嗪的应用，哪项是错误的
A. 人工冬眠疗法
B. 精神分裂症
C. 药物引起的呕吐
D. 晕动病引起的呕吐
E. 躁狂症

正确答案：D。晕动病引起的呕吐

解析：氯丙嗪对于精神分裂症的患者能够迅速缓解阳性症状（进攻、亢进、妄想、幻觉等）；也对多种药物（洋地黄、吗啡、四环素等）和疾病（尿毒症和恶性肿瘤）引起的呕吐具有显著的镇吐作用。对顽固性呃逆具有显著疗效。对晕动症无效。掌握“氯丙嗪”知识点。